适用于阳偏衰的治法是
A. 阳病治阴
B. 阴病治阳
C. 阳中求阴
D. 阴中求阳
E. 阴阳互补

正确答案：B。阴病治阳

解析：“阴病治阳”指的是机体阳虚，导致出现虚寒症状，即阴证之象，而论治时，以补阳为主，“益火之源，以消阴翳”。形成阳虚的主要原因，多是先天禀赋不足，或后天失养，或劳倦内伤，或久病损耗阳气，人体阳气虚衰，突出地表现为温煦、推动和气化功能减退。阳气的温煦功能减弱，人体热量不足，难以温暖全身而出现寒象，可见畏寒肢冷等症；推动作用减弱，可见精神萎靡，喜静，便秘等症；气化功能失司，脏腑经络等功能活动减退，则可出现水湿停聚和痰饮水肿。治疗时则多选用温阳助阳之品，即为“阴病治阳”（B对）。